胰岛素受体属于
A. G蛋白偶联受体
B. 酪氨酸激酶受体
C. 配体门控离子通道受体
D. 细胞内受体
E. 电压门控离子通道受体

正确答案：B。酪氨酸激酶受体

解析：本题考查受体的类型。胰岛素受体属于酪氨酸激酶受体（B对）。胰岛素及一些生长因子的受体本身具有酪氨酸蛋白激酶的活性，称为酪氨酸蛋白激酶受体。G蛋白偶联受体（A错）：许多激素的受体、M胆碱受体、肾上腺素受体、多巴胺受体、5-HT受体、前列腺素受体以及一些多肽类受体等。配体门控离子通道受体（C错）：N型乙酰胆碱受体、γ-氨基丁酸（GABA）受体等。细胞内受体（D错）：甾体激素、甲状腺激素、维生素D及维生素A受体等。电压门控离子通道受体（E错）：主要有钠、钾、钙 等离子通道。